适宜餐前嚼服的助消化药是
A. 雷尼替丁
B. 乳酸菌素
C. 前列地尔
D. 泮托拉唑
E. 铝碳酸镁

正确答案：B。乳酸菌素

解析：本题考查乳酸菌素。乳酸菌素（B对）为助消化药，整片吞服后在消化道内不易溶解，嚼碎后服用有利于药物在消化道内溶解吸收。